属于药品质量缺陷的情况有
A. 注射用安瓿瓶字迹不清
B. 腺苷钴胺糖衣色泽不均
C. 精蛋白锌胰岛素注射液外观可见沉淀物
D. 对乙酰氨基酚片为白色
E. 维生素C注射液外观澄色黄色

正确答案：A、B、C、E。注射用安瓿瓶字迹不清；腺苷钴胺糖衣色泽不均；精蛋白锌胰岛素注射液外观可见沉淀物；维生素C注射液外观澄色黄色

解析：本题考查药品质量缺陷。药品质量缺陷包括药品外包装受损（A对）；剂型、颜色、味道、气味、形态、重量、粒度等性状发生改变（B对）；储存条件不当发生变质（C对）或混入异物（E对）。对乙酰氨基酚片为白色（D错）不能看出质量缺陷。